性寒，善治风湿热痹的药物是
A. 青风藤
B. 臭梧桐
C. 雷公藤
D. 防己
E. 五加皮

正确答案：D。防己

解析：本题考查的是防己的性味归经与主治病证。性寒，善治风湿热痹的药物是防己（D对）。防己：【性味归经】苦、辛，寒。归膀胱、肾、脾经。【主治病证】（1）风湿痹痛，尤以热痹为佳。（2）水肿，腹水，脚气浮肿，小便不利。青风藤（A错）：【性味归经】苦、辛，平。归肝、脾经。【主治病证】（1）风湿痹痛，关节肿胀，拘挛麻木。（2）脚气浮肿。臭梧桐（B错）：【性味归经】辛、苦，凉。归肝经。【主治病证】（1）风湿痹痛。（2）肢体麻木，半身不遂。（3）湿疹瘙痒（外洗）。（4）高血压病。雷公藤（C错）：【性味归经】苦、辛，凉。有大毒。归心、肝经。【主治病证】（1）风湿顽痹，拘挛疼痛。（2）疔疮肿毒，腰带疮，湿疹，麻风，疥癣。五加皮（E错）：【性味归经】辛、苦、微甘，温。归肝、肾经。【主治病证】（1）风湿痹痛，四肢拘挛。（2）肝肾不足所致的腰膝软弱、小儿行迟。（3）水肿，脚气浮肿。